小剂量阿司匹林预防血栓形成的机制是
A. 抑制磷脂酶
B. 抑制TXA₂的合成
C. 减少PGI₂的合成
D. 抑制凝血酶原
E. 减少花生四烯酸的合成

正确答案：A。抑制磷脂酶